软垢覆盖面积占牙面1/3以下，根据DI-S记分标准为
A. 0
B. 1
C. 2
D. 3
E. 4

正确答案：B。1

解析：本题考查牙周病流行病学及分级预防。（DI-S）1（B对）＝软垢覆盖面积占牙面1/3以下。